患者在体检时HbsAg（+），平时无不适，检查无异常，活检，肝细胞质不透明，肝内颗粒状小体为
A. 毛玻璃样肝细胞
B. 气球样变肝细胞
C. 嗜酸性样肝细胞
D. 嗜酸性小体
E. 点状坏死肝细胞

正确答案：D。嗜酸性小体

解析：光镜下见病变肝细胞由于胞质水分脱失浓缩使肝细胞体积变小，胞质嗜酸性增强为嗜酸性小体，符合题意（D对）。